制定化学毒物卫生标准最重要的毒性参考指标是
A. LD₀
B. LD₅₀
C. LD₁₀₀
D. NOAEL和LOAEL

正确答案：D。NOAEL和LOAEL

解析：本题考查制定化学毒物卫生标准最重要的毒性参考指标。制定化学毒物卫生标准最重要的毒性参考指标是LOAEL或NOAEL（D对ABC错）。LOAEL即观察到有害作用的最低水平，是指在规定的暴露条件下，化学物引起机体（人或实验动物）某种有害作用的、已被观测到的最低剂量或浓度。NOAEL即未观察到有害作用的水平，是指在规定的暴露条件下，外源化学物不引起机体（人或实验动物）可检测到的有害作用的最高剂量或浓度。